瘿病之肝火痰瘀证，治宜用
A. 六味地黄汤合黄连阿胶汤
B. 丹栀逍遥散合消瘰丸
C. 龙胆泻肝丸
D. 一贯煎合消瘰丸
E. 天王补心丸

正确答案：B。丹栀逍遥散合消瘰丸

解析：瘿病之肝火痰瘀证，治宜用丹栀逍遥散合消瘰丸（B对）。阴虚火旺宜用六味地黄汤合黄连阿胶汤（A错）。龙胆泻肝丸治肝经湿热下注，肝火上炎证（C错）。一贯煎合消瘰丸为滋阴疏肝，软坚散结治阴虚痰结之证（D错）。天王补心丸治心肝阴虚证（E错）。